止泻效果明显的药物是
A. 曲马朵
B. 罗通定
C. 哌替啶
D. 吗啡
E. 纳洛酮

正确答案：D。吗啡

解析：吗啡可用于急、慢性消耗性腹泻以减轻症状（D对）。曲马多为中枢性镇痛药，镇痛效力与喷他佐辛相当，镇咳效力为可待因的1/2，呼吸抑制作用弱，对胃肠道无影响，亦无明显的心血管作用（A错）。罗通定有镇静、安定、镇痛和中枢性肌肉松弛作用（B错）。哌替啶无明显止泻和引起便秘作用（C错）。纳洛酮能有效地消除呼吸抑制、意识模糊、瞳孔缩小和肠蠕动减弱等中毒症状（E错）。